疮疡温阳托毒法的代表方是
A. 透脓散
B. 托里消毒散
C. 托里透脓汤
D. 四妙汤
E. 神功内托散

正确答案：E。神功内托散

解析：透脓散出自《外科正宗》，组成为黄芪、炒山甲、川芎、当归、皂角针，为透托法的代表方（A错）；托里消毒散出自《校注妇人良方》，组成为人参、黄芪、当归、川芎、炒白芍、白术、茯苓、金银花、白芷、甘草，为益气托毒法的代表方（B错）；托里透脓汤出自《医宗金鉴》，组成为人参、白术、炒山甲、白芷、升麻、甘草、当归、生黄芪、皂角刺、炒青皮，属益气托毒法（C错）。四妙汤出自《外科说约》，组成为黄芪、当归、银花、甘草，为益气托毒法（D错）。神功内托散出自《外科正宗》，组成为当归、白术、黄芪、人参、白芍、茯苓、陈皮、附子、木香、炙甘草、川芎、炒山甲，内有附子温阳，为温阳托毒法的代表方（E对）。